西地那非引起的不良反应是
A. 嗜睡乏力
B. 低血糖
C. 视觉异常
D. 出血
E. 骨质疏松

正确答案：C。视觉异常

解析：本题考查西地那非的不良反应。西地那非不良发应常见头痛、面部潮红、消化不良、鼻塞和眩晕，视物模糊、复视或视觉蓝绿模糊（C对）。嗜睡乏力（A错）不良反应常见于中枢神经系统抑制性药。低血糖（B错）不良反应常见于降糖药。出血（D错）不良反应常见于抗凝血药物。骨质疏松（E错）不良发应常见于糖皮质激素类药物。